女，48岁。因胆道梗阻，并发休克入院。使用去甲肾上腺素升压，血压不易维持，波动较大，应用氢化可的松后血压升并维持平稳。治疗3天时，患者出现精神失常，躁狂。加用氢化可的松后，去甲肾上腺素升压作用增强的这种现象
A. 糖皮质激素的允许作用
B. 两种药物作用的协同
C. 糖皮质激素的刺激作用
D. 糖皮质激素的抗感染作用
E. 两种药物作用的叠加

正确答案：A。糖皮质激素的允许作用

解析：糖皮质激素对有些组织细胞虽无直接活性，但可给其他激素发挥作用创造有利条件，称为允许作用。例如糖皮质激素（氢化可的松）可增强儿茶酚胺（去甲肾上腺素）的血管收缩作用，从而使去甲肾上腺素的升压作用增强（A对）。